男，65岁、反复咳嗽、咳痰20年，加重伴心悸、气短1周，咳大量脓痰，心悸、气短于夜间平卧时更明显，高血压病史3年。查体：BP150/90mmHg，双肺呼吸音低，三尖瓣区可闻及3/6级收缩期杂音。脊柱后凸畸形，心电图示RV₁+SV₅=1.18mV，右束支传导阻滞，该患最可能的诊断是
A. 风湿性心脏瓣膜病
B. 原发性心肌病
C. 高血压性心脏病
D. 冠心病
E. 慢性肺源性心脏病

正确答案：E。慢性肺源性心脏病

解析：65岁老年男性患者，反复咳嗽、咳痰20年（慢性阻塞性肺疾病病史），加重伴心悸、气短1周，咳大量脓痰，心悸、气短于夜间平卧时更明显（提示感染，COPD急性加重期，右心衰表现），高血压病史3年。查体：BP150/90mmHg，双肺呼吸音低，三尖瓣区可闻及3/6级收缩期杂音（COPD导致肺动脉高压，右心室代偿肥大，三尖瓣相对性关闭不全）。脊柱后凸畸形可导致通气障碍，心电图示RV₁+SV₅=1.18mV（RV₁+SV₅≥1.05mV提示右心室肥厚），右束支传导阻滞（常见于肺源性心脏病），综合患者病史、体征及辅助检查结果，考虑慢性肺源性心脏病（E对）。风湿性心脏瓣膜病（A错）往往有风湿性关节炎和心肌炎病史，其他瓣膜如二尖瓣、主动脉瓣常有病变，X线、心电图、超声心动图有特殊表现。原发性心肌病（B错）多为全心增大，无慢性支气管、肺疾病史，无肺动脉高压的X线表现等。高血压性心脏病（C错）为慢性高血压失代偿期表现，有慢性高血压病史，后期通常表现为左心室肥大及左心衰，故排除。冠心病（D错）也表现为心肌缺血，但多有心绞痛病史，通常无呼吸系统表现，故不选。